全口义齿初戴时发现下牙弓明显后退其原因可能是
A. 人工牙排列不当
B. 病员下颌骨过于后退
C. （牙合）架前后移动
D. 确定水平颌位关系时，下颌前伸
E. 垂直距离过低

正确答案：D。确定水平颌位关系时，下颌前伸

解析：本题考查下牙弓明显后退的原因。确定水平颌位关系时，若下颌前伸（D对），那么初戴义齿时，当下颌回到正中咬合位置时就会出现下颌义齿后退现象。人工牙排列不当（A错）一般不会导致下牙弓明显后退。患者下颌骨过于后退（B错）时，若义齿制作过程规范，咬合恢复良好，则不会引起下牙弓明显后退，一般也会处于正常范围甚至可以改善下颌骨后退的情况。（牙合）架前后移动（C错）是确定颌位关系过程中必要的操作步骤，不会导致下牙弓后退。垂直距离过低（E错）可致面下1/3距离减小，咀嚼肌紧张度减低等，但也不会导致下牙弓后退。